针灸治疗肠痈以
A. 足厥阴经任脉穴为主
B. 足少阳经冲脉穴为主
C. 任脉冲脉经穴为主
D. 足阳明经穴为主
E. 任脉手阳明经穴为主

正确答案：D。足阳明经穴为主

解析：肠痈治疗主穴可选用天枢、上巨虚、阑尾穴、曲池、足三里等。本方的主要作用是通调手足阳明的经气，调整阳明腑气，达到清热导滞，通腑调气之效。根据“合治内府”的原则，取胃经之合穴足三里以疏导足阳明经，阑尾为治疗阑尾炎之有效穴，且分布于胃经，可通泻肠腑之积热。曲池为大肠经合穴，泻之以疏泄肠中热邪，取大肠之募穴天枢，配以下合穴上巨虚，以通调肠腑之气机（D对）。